治疗慢性粒细胞性白血病热毒壅盛证，应首选
A. 膈下逐瘀汤
B. 青蒿鳖甲汤
C. 八珍汤
D. 清营汤合犀角地黄汤
E. 沙参麦门冬汤

正确答案：D。清营汤合犀角地黄汤

解析：清营汤合犀角地黄汤可以清热解毒，扶正祛邪，用于治疗慢性粒细胞性白血病热毒壅盛证（D对）。膈下逐瘀汤（A错）用于瘀血内阻证。青蒿鳖甲汤（B错）用于阴虚内热证。八珍汤（C错）用于气血两虚证。沙参麦冬汤（E错）用于燥伤肺胃阴分。